排石颗粒除通淋排石外，又能
A. 行气利湿
B. 分清化浊
C. 清热利水
D. 利湿行水
E. 除湿祛痰

正确答案：C。清热利水

解析：本题考查的是排石颗粒的功能。排石颗粒除通淋排石外，又能清热利水（C对）。排石颗粒：【功能】清热利水，通淋排石。萆薢分清丸：【功能】分清化浊（B错），温肾利湿。五苓散：【功能】温阳化气，利湿行水（D错）。功能为行气利湿（A错）或除湿祛痰（E错）的中成药，2022年考试指南未明确说明。